某县医院收治了数名高热伴头痛、鼻塞、流涕、全身酸痛等症状的患者，后被确诊为H7N9流感。为了防止疾病传播，该医院严格按照有关规定立即对患者予以隔离和治疗，同时在规定的时限内向当地卫生计生行政部门进行了报告。该规定时限是
A. 3小时
B. 5小时
C. 4小时
D. 1小时
E. 2小时

正确答案：E。2小时

解析：该县医院收治了多名确诊感染高致病性禽流感H7N9的病人。根据卫生部《传染病信息报告管理规范》，责任报告单位（该县医院）和责任疫情报告人发现人感染高致病性禽流感的病人或疑似病人时，或发现其他传染病或不明疾病暴发时，应当于2小时（E对）内向当地卫生计生行政部门报告。